关于维生素K的叙述，错误的是
A. 止血作用与凝血因子ⅡⅦⅨⅩ有关
B. 对先天性或严重肝病所致的低凝血酶原血症无效
C. 维生素K₁K₂为水溶性维生素
D. 用于胆道蛔虫所致的胆绞痛
E. 用于维生素K缺乏引起的出血

正确答案：C。维生素K₁K₂为水溶性维生素

解析：其中K₁存在于绿色植物中，K₂来自肠道细菌或腐败鱼粉，二者均为脂溶性维生素，需胆汁协助吸收（C错，为本题正确答案）。维生素K是肝脏中羧化酶的辅酶。在肝脏合成的凝血因子Ⅱ、Ⅶ、Ⅸ、X和蛋白质C等的前体物质（A对）。梗阻性黄疸、胆瘘、慢性腹泻和广泛肠段切除后因吸收不良所致的低凝血酶原血症（B对）。维生素K应用于生素K缺乏引起的出血（E对）。维生素K₁或K₂肌注有解痉止痛作用，可用于胆道蛔虫所致的胆绞痛（D对）。